在一项饮酒和胃癌关系的病例对照研究中，如果对照组女性比例显著高于病例组，可能会产生的偏倚为
A. 失访偏倚
B. 混杂偏倚
C. 信息偏倚
D. 回忆偏倚
E. 测量偏倚

正确答案：B。混杂偏倚

解析：本题考查混杂偏倚。混杂偏倚（B对ACDE错）是指某个既与疾病有关系，又与所研究的暴露因素有联系的外来因素的影响，掩盖或夸大了暴露与疾病的联系，所造成的偏倚。